叶呈心形至肾状心形，全缘，气辛香的中药材是
A. 薄荷
B. 广藿香
C. 青蒿
D. 细辛
E. 蒲公英

正确答案：D。细辛